典型胸椎形态的主要特点为
A. 有横突肋凹，棘突朝后，关节突的关节面呈水平位
B. 椎体有肋凹，上、下关节突的关节面呈冠状位
C. 棘突朝下后方，上、下关节突的关节面呈矢状位
D. 有横突肋凹，棘突呈板状平伸向后
E. 横突有孔，关节突的关节面呈矢状位

正确答案：B。椎体有肋凹，上、下关节突的关节面呈冠状位

解析：胸椎椎体两侧面后份的上缘和下缘处，有半圆形浅凹，称上、下肋凹，上、下关节突的关节面呈冠状位（AC错）。在横突末端前面，有横突肋凹与肋结节相关节 （B对E错）。胸椎棘突较长，向后下方倾斜，各相邻棘突呈叠瓦状排列（D错）。